有关皮神经的叙述哪个是对的
A. 皮神经不但含有感觉纤维而且含有内脏运动纤维
B. 皮神经只含感觉纤维，管理皮肤感觉
C. 第三肋间神经受损时可引起第三肋间隙的感觉缺失
D. 皮神经不但传导痛、温、触、压觉而且还传导本体感觉
E. 发出纤维组成皮神经的神经元为双极神经元，其胞体在脊神经节内

正确答案：A。皮神经不但含有感觉纤维而且含有内脏运动纤维

解析：皮神经为分布于皮肤的神经，含有感觉纤维和内脏运动纤维（A对B错）。第三肋间神经的皮支分布于胸外侧壁和肩胛区的皮肤及胸前壁的皮肤及胸膜壁层的内侧份（C错）。皮神经只能传导痛、温、触、压觉，不能传导本体感觉（D错）。